念珠菌病用
A. 青霉素
B. 制霉菌素
C. 阿昔洛韦
D. 糖皮质激素
E. 异烟肼

正确答案：B。制霉菌素

解析：本题考查口腔黏膜病的药物治疗。念珠菌病用制霉菌素（B对）。青霉素（A错）为治疗敏感的G⁺球菌和杆菌、C球菌及螺旋体所致感染的首选药。阿昔洛韦（C错）为抗病毒药物，用于治疗疱疹性口炎等。糖皮质激素（D错）具有抗炎、抗过敏、免疫抑制作用。异烟肼（E错）为治疗结核病的首选药。